国家免疫规划的制定部门是
A. 国务院卫生主管部门
B. 国务院财政主管部门
C. 省级人民政府卫生主管部门
D. 县级以上地方人民政府卫生主管部门
E. 国务院卫生主管部门会同国务院财政主管部门

正确答案：A。国务院卫生主管部门